若切牙管囊肿全位于切牙乳头的软组织内，则为
A. 切牙管囊肿
B. 鼻牙槽囊肿
C. 龈乳头囊肿
D. 根尖周囊肿
E. 鼻唇囊肿

正确答案：C。龈乳头囊肿

解析：本题考查口腔颌面部囊肿。若切牙管囊肿全位于切牙乳头的软组织内，则为龈乳头囊肿（C对）。鼻腭管（切牙管）囊肿来源于切牙管内的鼻腭导管上皮剩余，可表现为切牙管囊肿（A错）和龈乳头囊肿，前者发生于骨内，后者则完全位于切牙乳头的软组织内。鼻唇（鼻牙槽）囊肿（BE错）是一种发生于牙槽突表面近鼻孔基部软组织内的囊肿，较为少见。根尖周囊肿（D错）是颌骨内最常见的牙源性囊肿，属于炎症性囊肿。